可用于检识苯及蒽醌的试剂是
A. 无色亚甲蓝乙醇溶液
B. 醋酐-浓硫酸
C. 盐酸-镁粉
D. Molish 试剂
E. 碘化铋钾

正确答案：A。无色亚甲蓝乙醇溶液

解析：本题考查的是醌类衍生物的显色反应。可用于检识苯及蒽醌的试剂是无色亚甲蓝乙醇溶液（A对）。无色亚甲蓝乙醇溶液（1mg/ml）专用于检出苯醌及萘醌。样品在白色背景下呈现出蓝色斑点，可与蒽醌类区别。醋酐-浓硫酸（B错）反应，此反应可以区分三萜皂苷和甾体皂苷，前者最后呈红色或紫色，后者最终呈蓝绿色。盐酸-镁粉（C错）反应是鉴别黄酮类化合物最常用的颜色反应。糖的显色反应中最重要的是Molish（D错）反应，常用的试剂由浓硫酸和α-萘酚组成。生物碱沉淀反应主要用于检查中药或中药制剂中生物碱的有无，在生物碱的定性鉴别中，这些试剂可用于试管定性反应，或作为薄层色谱和纸色谱的显色剂（常用碘化铋钾试剂）（E错）。